下列有关地图舌的临床表现描述中，不恰当的说法是
A. 剥脱逐渐扩大
B. 又称为剥脱性舌炎
C. 患者自觉症状明显
D. 丝状乳头呈片状剥脱
E. 舌背形成光滑的红色剥脱区

正确答案：C。患者自觉症状明显

解析：地图舌表现为舌背丝状乳头呈片状剥脱，微凹陷，形成光滑的红色剥脱区，故也称剥脱性舌炎。但是菌状乳头常清晰可见，其边缘为白色微高起的弧形、圆形或椭圆形包绕。患者一般无明显的自觉症状，有时有烧灼感或刺激性痛。掌握“地图舌、沟纹舌及舌乳头炎”知识点。